发热，汗自出时时恶风心烦口燥渴脉洪大，治用
A. 竹叶石膏汤
B. 栀子豉汤
C. 白虎汤
D. 桂枝汤
E. 白虎加人参汤

正确答案：E。白虎加人参汤

解析：伤寒误治，迁延不解，表邪入里化热，阳明胃热炽盛，故曰“热结在里”。里热外蒸，邪热弥漫周身，充斥内外，因而就形成了“表里俱热”的阳明证。热盛津伤，胃中干燥，故口大渴；欲饮水数升，是言渴饮之甚；舌上干燥而烦，是言津伤之甚。其中“烦”字指心烦，既是热扰心神之象，也是津伤渴甚所致。热盛汗出多，津气两伤，且汗出腠理开泄，不胜风袭，故见时时恶风。本证属阳明胃热弥漫，津气两伤，故治以白虎加人参汤清热益气生津（E对）。